下列哪项不是窝洞的抗力形
A. 倒凹
B. 洞深
C. 盒状洞形
D. 阶梯
E. 窝洞的外形

正确答案：A。倒凹

解析：本题考查窝洞的抗力形。倒凹属于窝洞的固位形（A错，为本题的正确答案）。窝洞的抗力形是使充填体和余留的牙体组织获得足够的抗力，在承受咬合力时不折裂的形状。窝洞的主要抗力形结构包括：洞深（B对）、盒状洞形（C对）、阶梯结构（D对）、窝洞外形（E对）等。